餐后服用可以增加吸收的药物是
A. 维生素B₂片
B. 左甲状腺素钠片
C. 头孢拉定胶囊
D. 磷酸铝凝胶
E. 硫酸亚铁片

正确答案：A。维生素B₂片

解析：本题考查维生素B₂片。餐后服用可以增加吸收的药物是维生素B₂（A对）。维生素B₂的特定吸收部位在小肠上部，若空腹服用则胃排空快，而餐后服用可延缓胃排空，增加吸收。左甲状腺素钠片（B错）用于先天性甲状腺功能减退症（克汀病）与儿童及成人的各种原因引起的甲状腺功能减退症的长期替代治疗。头孢拉定胶囊（C错）用于敏感菌所致的各种炎症。磷酸铝凝胶（D错）用于胃及十二指肠溃疡及反流性食管炎等酸相关性疾病的抗酸治疗。硫酸亚铁片（E错）用于各种原因引起的缺铁性贫血。